运输高致病性病原微生物菌（毒）种或者样本，应当由不小于几人的专人护送
A. 2人
B. 3人
C. 4人
D. 5人
E. 1人

正确答案：A。2人